顺利完成各种活动所必备的基本能力是
A. 语言能力
B. 想象能力
C. 判别能力
D. 特殊能力
E. —般能力

正确答案：E。—般能力

解析：此题为概念题。一般能力是指在任何活动中都必须具备的能力（E对）。具体表现为观察力、注意力、记忆力、想象力和思维能力五个方面，也就是人们通常所指的智力。特殊能力（D错）是指在某种专门活动中所表现出的能力。它是顺利完成某种专业活动的心理条件。如音乐活动中必须具备音乐表象能力和节奏感的能力。